副交感神经节细胞膜上的受体为
A. α受体
B. β受体
C. β₂受体
D. M受体
E. N₁受体

正确答案：E。N₁受体